男，47岁。从3米高处坠落致左胸外伤8小时。查体：T36.5℃，P95次/分，R16次/分，BP100/60mmHg，神清，气管居中，反常呼吸运动，左胸壁可触及多根多处肋骨断端，左肺呼吸音明显减弱。最佳治疗方案首选
A. 胸腔闭式引流
B. 胸腔穿刺排气排液
C. 开胸探查+肋骨固定
D. 胸壁加压包扎
E. 镇静止痛，鼓励排痰

正确答案：E。镇静止痛，鼓励排痰

解析：中年男性患者，高处坠落伤，致左胸外伤8小时。查体：T:36.5℃，P:95/分，R:16/分，BP:100/60mmHg，神志清楚，气管居中，胸壁反常呼吸，可触及左胸多处肋骨断端（多根多处肋骨骨折），左肺呼吸音减弱，诊断为闭合性多根多处肋骨骨折，肋骨骨折的处理原则为有效控制疼痛、肺部物理治疗和早期活动，有效镇痛能增加患者的肺活量、潮气量、功能残气量、肺顺应性和血氧分压，降低呼吸道阻力和连枷胸壁的反常活动，同时在充分镇痛的支持下，肺部物理治疗能协助病人深呼吸与有效咳嗽，排除呼吸道分泌物，促进肺扩张，避免和减少呼吸道感染等并发症（E对）。外部固定肋骨（D错）和控制反常呼吸运动的各种物理方法，如多带条胸布、弹性胸带、宽胶布固定、胸部外牵引固定等，因其效果有限，弊端不少而逐渐减少使用。开胸探查+肋骨固定（C错）多用于进行性血胸并多根多处肋骨骨折的治疗。胸腔闭式引流（A错）、胸腔穿刺排气排液（B错）主要用于有明显血气胸的患者，该患者气管居中，血压正常，无提示有气胸或血胸的临床表现。